增加药物溶解度的方法不包括
A. 加入增溶剂
B. 加入助溶剂
C. 制成共晶
D. 加入助悬剂
E. 使用混合溶剂

正确答案：D。加入助悬剂

解析：本题考查增加药物溶解度的方法。加入助悬剂（D错，为本题正确答案）。提高混悬剂稳定性的方法。增加药物溶解度的方法：①加入增溶剂（A对）。②加入助溶剂（B对）。③制成盐类。④使用混合溶剂（E对）。⑤制成共晶（C对）。此外，提高温度、改变pH可促进药物的溶解；应用微粉化技术可减小粒径，促进药物溶解；固体分散体、包合技术等新技术的应用也可促进药物的溶解。